饮用水及游泳池消毒用
A. 0.05%～1%苯扎溴铵（新洁尔灭）
B. 75%乙醇
C. 0.05%～1%度米芬
D. 0.2～0.5μg/L氯
E. 0.1%～0.5%过氧乙酸

正确答案：D。0.2～0.5μg/L氯